下列哪种软骨发育的最终结果为中耳的砧骨和锤骨、蝶锤韧带
A. 下颌软骨
B. 髁突软骨
C. 上颌软骨
D. 腭骨软骨
E. 颞骨软骨

正确答案：A。下颌软骨

解析：下颌软骨对下颌骨发育几乎无贡献，只是作为下颌骨发育的一个支架。其命运是后部形成中耳的砧骨和锤骨、蝶锤韧带。掌握“唾液腺与颌骨的发育”知识点。